初孕妇，26岁。妊娠38周，阴道流液4小时，无阵发性腹痛。体温36.8度，腹部无压痛，胎心率140次/分，胎儿大小与实际孕周相符。血WBC10×10⁹/L。该患者最恰当的处理措施是
A. 期待疗法
B. 观察12小时，如仍未临产行剖宫产
C. 立即行剖宫产术
D. 不予处理，等待自然分娩
E. 观察12小时，如仍未临产给予引产

正确答案：E。观察12小时，如仍未临产给予引产

解析：该初孕妇妊娠38周，阴道流液4小时，无阵发性腹痛（胎膜早破患者突感有较多液体从阴道流出，无腹痛等其他征兆），诊断为足月胎膜早破。若胎儿情况良好，一般在破膜后12小时内自然临产；若12小时内未临产，可予以药物引产。本例胎心率140次/分（正常值在110～160bpm），胎儿大小与实际孕周相符，说明胎儿情况良好，该足月胎膜早破的患者应观察12小时，如仍未临产给予引产（E对BD错）。期待疗法（P134）（A错）适用于妊娠28～35周、胎膜早破不伴感染者。剖宫产（P134）（C错）适用于胎头高浮，胎位异常，宫颈不成熟，胎肺成熟，明显羊膜腔感染，伴有胎儿窘迫的情况。